患者在医院遭受其他个体的直接感染或通过物品、环境而引起的间接感染导致的医院感染称为
A. 外源性感染
B. 交叉感染
C. 医源性感染
D. 自身感染
E. 带入感染

正确答案：B。交叉感染